某研究者为探讨脂肪摄入量与男性前列腺癌的关系，在社区内选择高脂肪和低脂肪摄入者各200名，从50岁开始对他们进行随访10年。在随访期间，高脂肪摄入组中有20人，低脂肪摄入者中有10人被诊断为前列腺癌。高脂肪摄入所致前列腺癌的特异危险度是
A. 30/100
B. 10/100
C. 15/100
D. 无法计算
E. 5/100

正确答案：E。5/100

解析：归因危险度AR又称特异危险度、危险度差和超额危险度，是暴露组发病率与对照组发病率相差的绝对值，它表示危险特异的归因于暴露因素的程度。依据上述公式AR=（20/200）-（10/200）=5/100（E对）。